Ⅱ度松动牙的松动幅度是
A. 不超过1mm
B. 1～2mm
C. 2～3mm
D. 3～4mm
E. 以上均不对

正确答案：B。1～2mm

解析：本题考查修复学临床检查。松动度的检查：以牙松动幅度计算：Ⅰ度松动：松动幅度不超过1mm。Ⅱ度松动：松动幅度为1～2mm（B对）。Ⅲ度松动：松动幅度大于2mm。